血管内流动的为静脉血的是
A. 主动脉
B. 肺动脉
C. 头臂干
D. 肺静脉
E. 腹腔干

正确答案：B。肺动脉

解析：肺动脉（B对）由右心室发出，其内流动的为静脉血。主动脉由左心室发出，其内流动的为动脉血。